男，20岁，突发呼吸困难，查体:体型瘦高，X线亮度增高，肺压缩40%，问可能会有
A. 患侧胸廓萎陷
B. 患肺泡通气量/血流量＞0.8
C. 吸气时向患侧偏
D. 胸膜腔压力升高
E. 患侧肺组织膨胀

正确答案：D。胸膜腔压力升高

解析：患者瘦高身材（容易引起肺大泡突然破裂）突发呼吸困难，肺压缩40%，诊断考虑自发性气胸。因胸膜腔积气引起气胸，所以会出现胸膜腔压力升高（D对）吸气时向健侧移位（C错）；患侧肺组织压缩（E错）；患侧胸廓不会萎陷（A错）；肺的呼吸面积减少，肺泡通气量下降（B错）。